男，30岁。间断水肿3年，血压升高4个月。查体：BP165/95mmHg，双下肢轻度水肿。尿沉渣镜检RBC30~8335/HP，尿蛋白定量1.5g/24h。SCr135µmol/L，Alb42g/L。患者降压治疗首选的药物是
A. 血管紧张素转换酶抑制剂
B. α受体拮抗剂
C. β受体括杭剂
D. 钙通道阻滞剂
E. 利尿剂

正确答案：A。血管紧张素转换酶抑制剂

解析：患者青年男性，高血压伴蛋白尿，肾功能尚可，ACEI具有减少尿蛋白作用，对肾脏靶器官受损的高血压病人具有较好的疗效，因此首选降压的药物是血管紧张素转换酶抑制剂（A对）。α受体拮抗剂（B错）副作用多，一般不主张单独使用。β受体括杭剂（C错）适用于不同程度高血压病人，尤其是心率较快的中、青年病人或合并心绞痛和慢性心力衰竭者，对老年高血压疗效相对较差。钙通道阻滞剂（D错）对于合并糖尿病、冠心病或外周血管病病人，尤其是老年病人为首选药物。利尿剂（E错）通常不作为首选，可增强其他降压药的疗效。